艾滋病的病原体是
A. 巨细胞病毒
B. EB病毒
C. 人类乳头状瘤病毒
D. 人类免疫缺陷病毒
E. 单纯疱疹病毒

正确答案：D。人类免疫缺陷病毒

解析：艾滋病是获得性免疫缺陷综合征（AIDS）的简称，是由人类免疫缺陷病毒（HIV）引起的性传播及可通过血液传染的传染病。掌握“艾滋病的口腔表征”知识点。